有关牙周组织病的概念以下哪项是错误的
A. 牙周组织病是牙龈，牙周膜，牙骨质，牙槽骨慢性炎症性疾病
B. 牙周炎一旦患病总是呈持续性破坏过程
C. 疾病的进展常呈活跃期和静止期交替出现
D. 不同个体对牙周致病因素的敏感度不同
E. 菌斑，牙石与牙周组织病关系十分密切

正确答案：B。牙周炎一旦患病总是呈持续性破坏过程

解析：本题考查牙周组织病。牙周组织病是牙龈，牙周膜，牙骨质，牙槽骨慢性炎症性疾病（A对），这些疾病包括牙龈病和牙周炎。牙龈病是指只发生在牙龈组织的疾病，而牙周炎则是累及四种牙周支持组织的炎症性、破坏性疾病。牙周炎病变呈静止期和加重期交替出现（C对）（B错，为本题的正确答案）。静止期的特征是炎症反应轻，没有或很少有骨和结缔组织的附着，活动期骨和结缔组织附着丧失以及牙周袋加深。不同个体对牙周致病因素的敏感度不同（D对），口腔卫生差、有吸烟习惯、有糖尿病等人群易患牙周炎。菌斑，牙石与牙周组织病关系十分密切（E对），菌斑是牙周病的始动因子，牙石能促进菌斑的附着，二者能加重牙周组织疾病的进展。